下列关于IgA肾病错误的说法是
A. 病理类型主要为系膜增生性肾小球肾炎
B. 确诊有赖于肾活检病理检查
C. 青少年好发
D. 预后良好，很少有肾功能恶化
E. 常在感染后72小时以内发作肉眼血尿

正确答案：D。预后良好，很少有肾功能恶化

解析：IgA肾病好发于青少年（C对），男性多见。起病前多有感染，常为上呼吸道感染（咽炎、扁桃体炎），其次为消化道、肺部和泌尿道感染。部分患者常在上呼吸道感染后（24～72小时，偶可更短）出现突发性肉眼血尿（E对）。确诊有赖于肾活检病理检查（B对）。IgA肾病病理变化多种多样，病变程度轻重不一，可涉及肾小球肾炎几乎所有的病理类型，但主要病理类型为系膜增生性肾小球肾炎（A对）。IgA肾病临床表现、病理改变和预后变异甚大，以IgA沉积为主的新月体性肾炎或伴毛细血管袢坏死，临床上常呈肾功能急剧恶化（D错，为本题正确答案）。